男性，17岁。半年前上前牙外伤冠折露髓未治，现因唇侧牙龈鼓包就诊，医师应做的最重要的检查项目是
A. 叩诊
B. 松动度
C. X线片
D. 温度测验
E. 牙周袋探诊

正确答案：C。X线片

解析：患者上前牙外伤冠折露髓已半年，现唇侧龈肿包，考虑最大的可能性是患慢性根尖周炎，最重要的可以确诊的检查项目是X线片检查。掌握“慢性根尖周炎”知识点。